“同病异治”中，不同的是
A. 病
B. 证
C. 症
D. 以上都是
E. 以上都不是

正确答案：B。证

解析：证即证候，是疾病过程中某一阶段的病机概括，通常由一组有内在联系的，能够反映疾病本质的相对固定的症状和体征构成。中医治病强调辩证论治，证同则治同，证异则治异，同一种病证型不同，治疗也不同，故同病异治中不同的是证（B对）。病（A错），是疾病的简称，有特定的致病因素、发病规律和病理演变的完整的异常生命过程。症（C错），是疾病过程中表现出的个别的、孤立的异常现象，包括症状和体征。